男，20岁，自述2个月来脑海里总是在回荡“你去死吧”的声音，有时很清晰有时不清晰。该患者最可能的症状是
A. 记忆障碍
B. 错觉
C. 真性幻觉
D. 假性幻觉
E. 人格解体

正确答案：D。假性幻觉

解析：患者脑海里总是在回荡“你去死吧”的声音，有时很清晰有时不清晰。该患者最可能的症状是假性幻觉（D对）。真性幻觉（C错）患者常常述说是亲耳听到或亲眼看到的。人格解体（E错）是指患者感受到完整的自我有分离的体验，即体验到自我的整体性分离，如躯体的完整性、心理活动与生理活动的分离等，或感到自己就像一个旁观者从外部来审视自我。